患者，男，75岁。患冠心病心绞痛。胸部闷痛，心悸盗汗，心烦不眠，头晕耳鸣，腰膝酸软，舌红少苔，脉沉细。其治法是
A. 益气养阴，通脉止痛
B. 活血化瘀，通络止痛
C. 滋阴益肾，养心安神
D. 益气活血，理气止痛
E. 散寒宣痹，理气温通

正确答案：C。滋阴益肾，养心安神

解析：患者患冠心病心绞痛，气血运行失畅，壅滞痹阻，故见胸部闷痛；心阴虚则心悸盗汗，心烦不眠；肾阴虚则见头晕耳鸣，腰膝酸软；舌红少苔，脉沉细均为心肾阴虚的表现，治疗需滋阴益肾，养心安神（C对）。益气养阴，通脉止痛（A错）治疗气阴两虚证。活血化瘀，通络止痛（B错）用于治疗心血瘀阻证。益气活血，理气止痛（D错）用于治疗气虚血瘀证。散寒宣痹，理气温通（E错）用于治疗阴寒凝滞证。